患者，男，67岁，为葡萄糖-6-磷酸脱氢酶缺乏症患者，如果使用复方磺胺甲噁唑，可能引发的药源性疾病是
A. 肌肉震颤
B. 红人综合征
C. 抗生素相关性腹泻
D. 急性溶血性贫血
E. 血小板减少

正确答案：D。急性溶血性贫血

解析：本题考查复方磺胺甲噁唑。可能引发的药源性疾病是急性溶血性贫血（D对）。复方磺胺甲噁唑的常见不良反应为过敏反应（表现为药疹，严重者可发生渗出性多形性红斑、剥脱性皮炎和大疱表皮松解萎缩性皮炎等），也表现有光敏反应、药物热、关节痛及肌痛、发热等血清病样反应，可出现中性粒细胞减少或缺乏症、血小板减少症、再生障碍性贫血，缺乏葡萄糖-6-磷酸脱氢酶者应用磺胺药后易发生溶血性贫血及血红蛋白尿，在新生儿和儿童中较为多见。肌肉震颤（A错）为中枢神经系统疾病的一个症状，主要由于黑质和黑质纹状体通路病变而引起，常见的疾病有脑炎、颅脑损伤、动脉硬化、基底节肿瘤，某些化学物质中毒，如汞、锰的慢性中毒也可以出现肌肉震颤的毒作用表现。红人综合征（B错）以脸、颈、躯干上部斑丘疹样红斑为特征，还可出现寒战、高热、瘙痒、心动过速、血管性水肿、胸痛、头晕等，不同的患者会有不同的表现，严重时可出现低血压及休克，甚至危及生命，多发生于万古霉素滴注过程中，与输注万古霉素的剂量及速度有关。抗生素相关性腹泻（C错）是指应用抗生素后发生的、与抗生素有关的腹泻。血小板减少（E错）是指血液中血小板计数<100×10⁹/L，血小板减少见于多种血液性疾病、风湿免疫病、放化疗损伤及药物相关性血小板减少。